指导、监督和管理其技术助理的处方调配、销售或供应过程是
A. 执业药师职业道德准则
B. 执业药师执业行为规范
C. 执业药师履行的职责
D. 执业药师行使的权力
E. 执业药师应尽的义务

正确答案：D。执业药师行使的权力